某男性患者，40岁。气喘发作2小时，检查发现呼吸急促，三凹征，缺氧，心率130次/分。如果病人血压高，应该选择下列哪种降压药
A. 可乐定
B. 哌唑嗪
C. 依那普利
D. 硝苯地平
E. 以上均可

正确答案：E。以上均可

解析：本题考查常用降压药物。某男性患者，40岁。气喘发作2小时，检查发现呼吸急促，三凹征，缺氧，心率130次/分。如果病人血压高，可选用可乐定（交感神经抑制剂）（A对）、哌唑嗪（α1受体拮抗剂）（B对）、依那普利（血管紧张素转换酶抑制剂）（C对）、硝苯地平（钙通道阻滞剂）（D对）。（ABCD均对，故E为本题的正确答案）。